病例对照研究中关于选择病例的方法，正确的是
A. 应符合统一的明确的诊断标准
B. 为保证病例诊断一致，应从同一医院选择全部对象
C. 最好是现患病例
D. 应尽量选择具有某种可疑危险因素的病例
E. 最好选择较典型的重病例

正确答案：A。应符合统一的明确的诊断标准